不属于免疫耐受机制的是
A. 克隆消除
B. 胸腺内阴性选择
C. T细胞克隆无能
D. 免疫抑制
E. B细胞克隆无能

正确答案：D。免疫抑制